混合牙列期的年轻恒牙，在修复牙体时应
A. 注意恢复咬合高度
B. 不能选用金属成品冠修复
C. 多用玻璃离子粘固粉做永久性充填，注意恢复牙齿间的接触点
D. 以恢复牙冠的解剖形态为目的，不强调恢复牙齿间的接触点
E. 注意彻底去除病变组织，恢复牙体外形及咬合关系

正确答案：D。以恢复牙冠的解剖形态为目的，不强调恢复牙齿间的接触点

解析：本题考查混合牙列期的年轻恒牙的修复治疗。混合牙列期的年轻恒牙建（牙合）不稳定，尚未达到正常的咬合关系，还存在一些暂时性错（牙合）现象，比如暂时的上中切牙间隙暂时性拥挤等。随着颌骨的发育，慢慢会建立正常的咬合关系，因此在修复年轻恒牙时，应该以恢复牙冠的解剖形态为目的，不强调恢复牙齿间的接触点（D对C错），以待其自行调整。混合牙列期有暂时性深覆（牙合），待后牙的咬合关系逐渐建立和改善后，切牙的深覆（牙合）现象可自行消失，并且混合牙列期颌骨还在生长，会帮助达到合适的咬合高度，因此在修复牙体时不需要注意恢复咬合高度（A错）。对于年轻恒牙，牙髓腔大，磨切牙体组织时易露髓，选择金属成品冠修复（B错），磨削牙体组织少，相比烤瓷熔附金属修复体更容易保护年轻恒牙牙髓。玻璃离子（C错）虽然有良好的粘接性能、生物相容性、释放氟离子以及耐溶解性，但是其物理机械性能较差，弹性模量低，脆性较大，抗张强度和抗压强度均较小，因此不多用于年轻恒牙永久性修复。年轻恒牙牙髓腔大，易露髓，而且龋坏多为急性龋，软化牙本质多，不必彻底去除病变组织（E错），可留少许软化牙本质，待复诊，无症状，牙髓活力正常时，应去除全部封物以及残余的软化牙本质，然后盖髓、垫底、永久充填。